直接作用于体温调节中枢引起发热的是
A. 病原体产生的外源性致热原
B. 病原体产生的内源性致热原
C. 白细胞产生的内源性致热原
D. 白细胞产生的外源性致热原
E. 白细胞及病原体产生的代谢产物

正确答案：C。白细胞产生的内源性致热原

解析：病原微生物属外源性致热原，通过激活血液中的中性粒细胞、嗜酸性粒细胞和单核吞噬细胞系统而间接作用于体温调节中枢，引起发热的内源性致热原，如白介素（白细胞产生）、肿瘤坏死因子、干扰素，可直接作用于体温调节中枢引起发热（C对）。